属左心室内结构的是
A. 隔缘肉柱
B. 界嵴
C. 三尖瓣
D. 室上嵴
E. 主动脉前庭

正确答案：E。主动脉前庭

解析：主动脉前庭（E对）位于左心室内，又称左心室流出道，由室间隔上部和二尖瓣前尖组成。